脑压过高，为预防脑疝最好选用
A. 呋塞米
B. 阿米洛利
C. 螺内酯
D. 乙酰唑胺
E. 甘露醇

正确答案：E。甘露醇

解析：甘露醇是治疗脑水肿、降低颅内压安全而有效的首选药物。也可用于青光眼急性发作和患者术前应用以降低眼内压。掌握“保钾利尿药和渗透性利尿药”知识点。